医疗器械说明书的内容要求包括
A. 应当真实、准确、科学
B. 应与产品实际性能（产品特性）一致
C. 应说明“治愈率”
D. 应有“无效退款”等承诺性语言
E. 应说明“有效率”

正确答案：A、B。应当真实、准确、科学；应与产品实际性能（产品特性）一致